粮谷类食物蛋白质的第一限制性氨基酸为
A. 苯丙氨酸
B. 蛋氨酸
C. 苏氨酸
D. 赖氨酸
E. 异亮氨酸

正确答案：D。赖氨酸

解析：本题考查粮谷类食物蛋白质的第一限制性氨基酸。粮谷类食物蛋白质一般所含的必需氨基酸组成不合理，粮谷类食物蛋白质的营养价值低于动物性食物，因其赖氨酸（D对ABCE错）含量低，通常为第一限制氨基酸。